胃之气阴不足的典型舌象是
A. 镜面舌
B. 地图舌
C. 红绛舌
D. 草莓舌
E. 霉酱舌

正确答案：B。地图舌

解析：“地图舌是指舌苔不规则地 剥脱，边缘凸起，界限清楚，形似地图，部位时有转移者”，属于剥苔范畴，一般主胃气不足，胃阴枯竭或气血两虚，亦是全身虚弱的一种征象，故胃之气阴不足的典型舌象是地图舌（B对）。“镜面舌，舌深绛无苔而光亮如镜，主胃气、胃阴枯涸；舌色晄白如镜，毫无血色，也称白光白舌，主营血大亏，阳气将脱，均属病危难治”(A错)。“红绛舌，若苔质焦黄干燥，见于邪热深重，胃肠热结；若苔质黑而干燥，见于热极伤阴；若苔质为无苔见于热入血分，阴虚火旺”（C错）。草莓舌，见于猩红热，其舌象表现为病初舌被白苔，红肿的乳头突出于白苔之外，称为白草莓舌；以后白苔脱落，露出鲜红舌面，舌乳头红肿明显并持续存在，称红草莓舌（D错）。霉酱舌指舌苔厚腻垢浊不化，状如霉酱，伴便秘、腹胀者，为宿食内积，中焦气机阻滞（E错）。